有关POP的说法，不正确的是
A. 废旧电线和电子垃圾回收金属熔融时可生成PCDDs和PCDFs
B. POP可对包括肝、肾等脏器及神经系统、内分泌系统、生殖系统、免疫系统等产生急性和慢性毒性，并具有明显的致癌、致畸、致突变等作用
C. POP在低浓度时不会对生物体造成伤害
D. 我国已开始对我国境内POP污染状况进行全面调查和监测
E. POP可通过胎盘和授乳传递给胎儿和婴儿，从而影响其发育

正确答案：C。POP在低浓度时不会对生物体造成伤害

解析：本题考查POP的相关内容。持久性有机污染物（POP）是指能持久存在于环境中，并可借助大气、水、生物体等环境介质进行远距离迁移，通过食物链富集，对环境和人类健康造成严重危害的天然或人工合成的有机污染物质。我国已开始对我国境内POP污染状况进行全面调查和监测（D对）。POP可对包括肝、肾等脏器及神经系统、内分泌系统、生殖系统、免疫系统等产生急性和慢性毒性，并具有明显的致癌、致畸、致突变等作用（B对）。POP也可通过胎盘和授乳传递给胎儿和婴儿，从而影响其发育（E对）。POP在低浓度时也会对生物体造成伤害（C错，为本题正确答案）。POP还具有生物放大效应，环境中低浓度的POP可通过食物链逐渐蓄积在人体内达到相当高的浓度而产生严重的危害。废旧电线和电子垃圾回收金属熔融时可生成多氯二苯并-对-二噁英（PCDDs）和多氯二苯并呋喃（PCDFs）（A对）。